下面对伤害和意外事故的阐述准确的有
A. 意外事故包括伤害
B. 伤害包括意外事故
C. 意外事故可以引起伤害
D. 意外事故是无意识的伤害
E. 意外事故与伤害无关

正确答案：C。意外事故可以引起伤害

解析：本题考查伤害和意外事故的相关内容。伤害既可以由传统意义上的“意外”事故（车祸、跌落、烧烫伤等）引起（目前称之为非故意伤害），也可以由一些蓄意的暴力行为事件（如谋杀、自杀、斗殴和虐待等）引起。由此可知，意外事故可以引起伤害（C对ABDE错）。